在单位时间内机体能将多少容积体液中的药物清除称为
A. t1/2
B. 生物利用度
C. 表观分布容积
D. 清除率
E. 达峰时间

正确答案：D。清除率

解析：本题考查清除率。清除率（D对）是指机体在单位时间内清除的含药血浆体积；t1/2（A错）为生物半衰期，是指血药浓度下降一半所需的时间；生物利用度（B错）是指药物经血管外途径给药后吸收进入全身血液循环的相对量；表观分布容积（C错）是体内药量与血药浓度相互关系的一个比例常数，用V=X/C表示；达峰时间（E错）指单次服药后，血药浓度达到峰值的时间。